以下关于颞间隙解剖特点的描述中，正确的是
A. 位于颞区
B. 可分为颞浅间隙和颞深间隙两部分
C. 借颧弓与颞下嵴的平面与颞下间隙分界
D. 翼下颌间隙向上与颞下间隙及颞间隙通连
E. 以上均正确

正确答案：E。以上均正确

解析：颞间隙位于颞区，借颧弓与颞下嵴的平面与颞下间隙分界，可分为颞浅间隙和颞深间隙两部分。掌握“面侧深区及颌面部各间隙的境界”知识点。